患儿，女，2岁。高热，面红气粗，频繁呕吐，神昏谵语，惊厥3次，舌红绛苔黄干，脉弦有力。检查：颈抵抗（+），腰穿示脑脊液压力增高，外观混浊，白细胞5200×10⁶/L，多核0.83。应首先考虑的是
A. 病毒性脑炎，痰热壅盛证
B. 结核性脑膜炎，热入心包证
C. 结核性脑膜炎，热甚伤阴证
D. 化脓性脑膜炎，毒邪内闭证
E. 化脓性脑膜炎，气营两燔证

正确答案：D。化脓性脑膜炎，毒邪内闭证

解析：根据患儿高热、呕吐、意识障碍，伴惊厥，查体：颈抵抗阳性，故定位于神经系统疾病，初步考虑脑膜炎，结合脑脊液压力增高，故应首先考虑化脓性脑膜炎--小儿化脓性脑膜炎临床主要以发热、头痛、呕吐、惊厥、意识障碍、颅内压增高、脑膜刺激征阳性及脑脊液脓性改变。典型化脑的脑脊液外观混浊，压力增高，白细胞总数显著增多，达1000×10⁶/L，分类以中性粒细胞为主，糖含量明显降低，常<1.1mmol/L，蛋白质含量增高，多>1g/L。根据“神昏谵语，惊厥，高热，面红气粗，舌红绛苔黄干，脉弦有力”，可辨证为毒热之邪内闭神窍（D对）--毒热外袭，伤及人体，毒邪稽留，由卫及气营，正邪激烈相争，气血上壅，故见高热，面红气粗；邪入气营，而气分证多在阳明，邪热扰胃，通降失司，气逆而上，故频繁呕吐；毒热扰心，故见神昏谵语；毒热炽盛，引动肝风，故见惊厥；舌红绛苔黄干，脉弦有力，为气营热盛之象（E错）。病毒性脑膜炎临床表现与化脑相似，全身感染中毒及神经系统症状不重，脑脊液外观清亮，白细胞数0～数百×10⁶/L，以淋巴细胞为主，糖含量正常，细菌学检查阴性，脑脊液中病毒特异性抗体和病毒分离有助诊断（A错）。结核性脑膜炎，除婴儿外，一般起病较缓，常有结核接触史及其他部位结核病灶；PPD检查阳性有重要参考价值；脑脊液外观呈毛玻璃状，白细胞数<500×10⁶/L，以淋巴细胞为主，涂片抗酸染色和结核菌培养可帮助确定诊断（BC错）。